上皮内淋巴细胞γδT细胞的作用是
A. 拮抗作用
B. 协同作用
C. 吞噬作用
D. 细胞毒作用
E. 以上说法均正确

正确答案：D。细胞毒作用

解析：上皮内淋巴细胞（IEL）是存在于小肠黏膜上皮内的一类独特的细胞群，包括αβT细胞（约占IEL的40%）和γδT细胞（约占IEL的60%）。γδT细胞有细胞毒作用，在免疫监视和黏膜免疫中具有重要作用。掌握“黏膜免疫”知识点。